关于慢性化脓性唾液腺炎的病理表现说法错误的是
A. 导管扩张，导管内有炎症细胞浸润
B. 导管周围及纤维间质中有淋巴细胞和浆细胞浸润
C. 导管周围及纤维间质中形成淋巴滤泡
D. 腺泡增生，扩大，纤维结缔组织减少
E. 小叶内导管上皮增生，可见鳞状化生

正确答案：D。腺泡增生，扩大，纤维结缔组织减少

解析：慢性化脓性唾液腺炎镜下见唾液腺导管扩张，导管内有炎症细胞；导管周围及纤维间质中有淋巴细胞和浆细胞浸润，或形成淋巴滤泡；腺泡萎缩、消失被增生的纤维结缔组织取代；小叶内导管上皮增生，并可见鳞状化生。掌握“慢性唾液腺炎的病理变化”知识点。